透照法，需要于光线暗淡的室内进行，可用于检查
A. 邻面龋坏
B. 牙髓是否坏死
C. 牙隐裂
D. 根管口
E. 以上均可

正确答案：E。以上均可

解析：本题考查透照法检查。透照法是用光导纤维进行检查的，可用于检查邻面龋坏（A对），还可以看出病变部位的深度与牙髓腔的关系，从而得知牙髓是否坏死（B对）。利用灯光、口镜多角度照射，深色液体浸染等，有助于牙隐裂的发现（C对）。寻找根管口借助透照，使用光导纤维束时，光源的顶端应该和牙的颈部成直角，减弱周围光线，牙髓腔将会呈现出微橙红色，而根管口看起来是黑点（D对）。（ABCD均对，故E为本题的正确答案）。